下列各项中，不属省级人民政府在接到报告1小时内，向国务院卫生行政主管部门报告的情形是
A. 发生或者可能发生传染病暴发、流行的
B. 发生或者可能发生重大畜类传染病暴发、流行的
C. 发生或者发现不明原因的群体性疾病的
D. 发生传染病菌种、毒种丢失的
E. 发生或者可能发生重大食物和职业中毒事件的

正确答案：B。发生或者可能发生重大畜类传染病暴发、流行的

解析：省、自治区、直辖市人民政府在接到报告1小时内，向国务院卫生行政主管部门报告的情形：①发生或者可能发生传染病暴发、流行的（A对）；②发生或者发现不明原因的群体性疾病的（C对）；③发生传染病菌种、毒种丢失的（D对）；④发生或者可能发生重大食物和职业中毒事件的（E对）。发生或者可能发生重大畜类传染病暴发、流行的不属省级人民政府在接到报告1小时内，向国务院卫生行政主管部门报告的情形（B错，为本题正确答案）。